特用于后牙洁治的器械有
A. 直角洁治器
B. 锄形洁治器
C. 大镰刀形洁治器
D. 弯镰刀形洁治器
E. 以上均是

正确答案：D。弯镰刀形洁治器

解析：本题考查洁治器械。特用于后牙洁治的器械有弯镰刀形洁治器（D对）。1.弯镰刀形洁治器，成对，其颈部形成一定角度，使工作端适应后牙外形，因其形似牛角形，也称牛角形洁治器。特用于后牙洁治。2.锄形洁治器（B错）：工作头外形如锄，左右成对，刃口一端成锐角，使用时锐角置于牙石侧的龈沟内，刮除龈上牙石及浅层龈下牙石，主要用整个刃口刮除光滑面上的色素、菌斑和牙石。